某女，38岁，素体虚弱，妊娠后突发胎漏，胎动不安，腰膝酸软。证属肝肾亏虚、冲任不固，宜选用的药是
A. 龙胆
B. 苦参
C. 竹叶
D. 苎麻根
E. 桑寄生

正确答案：E。桑寄生

解析：本题考查的是桑寄生的主治病证。素体虚弱，妊娠后突发胎漏，胎动不安，腰膝酸软。证属肝肾亏虚、冲任不固，宜选用的药是桑寄生（E对）。桑寄生：【主治病证】（1）风湿痹证，腰膝酸痛。（2）肝肾虚损，冲任不固所致的胎漏，胎动不安。龙胆（A错）：【主治病证】（1）湿热下注之阴肿阴痒、带下、阴囊湿疹，湿热黄疸。（2）肝火上炎之头痛目赤、耳聋胁痛等。（3）高热抽搐，小儿急惊，带状疱疹。苦参（B错）：【主治病证】（1）湿疮，湿疹，疥癣，麻风，阴痒，带下。（2）湿热黄疸、泻痢、便血。（3）湿热淋痛，小便不利。竹叶（C错）：【主治病证】（1）热病烦渴，心火上炎之口舌生疮。（2）热淋，小便不利。（3）热入心包之神昏谵语。苎麻根（D错）：【主治病证】（1）血热所致的各种出血证。（2）胎动不安，胎漏下血。（3）湿热淋痛，热毒疮肿，蛇虫咬伤。